缝合时造成创缘内卷的最主要原因可能是
A. 打结过紧
B. 进针过深
C. 打结过松
D. 两侧进出针间距大于皮下间距
E. 两侧进出针间距小于皮下间距

正确答案：D。两侧进出针间距大于皮下间距

解析：本题考查缝合。缝合时造成创缘内卷的最主要原因可能是两侧进出针间距大于皮下间距（D对）。切口两侧进出针间距大于皮下间距，易造成皮肤创缘内卷；相反，进出针间距小于皮下间距（E错），则皮肤创缘呈现过度外翻。